不符合休克早期临床症状的是：
A. 面色苍白
B. 四肢湿冷
C. 尿量减少
D. 血压不降低，脉压增大
E. 收缩压可稍升高

正确答案：D。血压不降低，脉压增大

解析：早期休克临床表现面色苍白（A对），四肢湿冷（B对），出冷汗，脉搏细速，脉压减小（D错，为本题正确答案），尿量减少（C对），烦躁不安，血压可骤降（如大失血），也可略降，甚至因代偿作用可正常或轻度升高（E对），但是脉压会明显缩小，患者脏器有效灌流量明显减少。